点隙窝沟龋好发于
A. 乳侧切牙
B. 乳磨牙
C. 年轻恒磨牙
D. 恒侧切牙
E. 以上均正确

正确答案：E。以上均正确

解析：本题考查龋病的临床表现与分类。点隙窝沟龋好发于乳侧切牙（A对）、乳磨牙（B对）、年轻恒磨牙（C对）、恒侧切牙（D对）。综上，选E。点隙窝沟龋多见于磨牙和前磨牙的咬合面、下磨牙的颊面、上磨牙的腭面、上前牙的腭面（尤其是上颌侧切牙的舌侧窝）。